患者大面积烧伤，用氨苄青霉素治疗7天后，骤起寒战高热39.5℃～40℃，病情迅速恶化，神志淡漠，嗜睡，血压下降，休克。查血：白细胞计数25×10⁹/L，分类见中幼与晚幼粒细胞，应首先考虑的诊断是
A. 革兰阴性细菌脓毒症
B. 革兰阳性细菌脓毒症
C. 真菌性脓毒症
D. 绿脓杆菌脓毒症
E. 脓毒败血症

正确答案：C。真菌性脓毒症

解析：患者因大面积烧伤用广谱抗生素氨苄青霉素治疗7天后，出现寒战高热39.5℃～40℃，病情迅速恶化，出现神志淡漠，嗜睡，血压下降，休克，查血白细胞计数25×10⁹/L，分类见中幼与晚幼粒细胞，诊断为真菌性脓毒症（C对）。革兰染色阴性杆菌脓毒症多见于胆道、尿路、肠道和大面积烧伤感染等。常见致病菌为大肠埃希菌、铜绿假单孢菌、变形杆菌、克雷伯菌、肠杆菌等，它们的毒素可以引起外周血管收缩，管壁通透性增加，微循环淤滞，并形成微血栓，细胞缺血、缺氧。临床特点是：一般以突然寒战开始，发热可呈间歇热，严重时体温不升或低于正常。病人四肢厥冷、发绀、少尿或无尿。有时白细胞计数增加不明显或反见减少。休克发生早，持续时间长（A错）。革兰染色阳性球菌脓毒症多见于严重的痈、急性蜂窝织炎、骨与关节化脓性感染等。主要致病菌为金黄色葡萄球菌，其毒素能使周围血管扩张，阻力降低。临床特点是：可有或无寒战，发热呈稽留热或弛张热。病人面色潮红，四肢温暖、干燥，谵妄和昏迷。常有皮疹、腹泻、呕吐、可出现转移性脓肿，易并发心肌炎。发生休克的时间较晚，血压下降也较缓慢（B错）。绿脓杆菌脓毒症多以突发寒战为初发症状，呈间歇性发热，严重时体温不升或低于正常。病人四肢厥冷、发绀、少尿或无尿。休克发生早，持续时间长有时白细胞计数增加不明显或反而减少，多无转移性脓肿（D错）。脓毒败血症临床表现主要为寒战、高热、关节痛、皮疹、肝脾肿大，部分患者还可出现烦躁、四肢厥冷及紫绀、脉细速、呼吸增快、血压下降等（E错）。